某男，63岁。平素肌肤不仁，手足麻木；2天前，晨起突发口眼㖞斜，语言不利，口角流涎，右侧肢体活动受限，关节酸痛；舌苔薄白，脉浮数。医师诊断为中风，治以祛风化痰通络，处方如下：制白附子6g，法半夏9g，蜈蚣3g，天麻9g，制天南星9g，枳壳9g，木香6g，全蝎9g，制川乌（先煎）3g；3剂，水煎服，每日1剂，早晚分服。方中蜈蚣有毒，临床偶见不良反应发生，下列不属于其不良反应的是
A. 恶心、呕吐、腹痛、腹泻，急性肝损伤
B. 过敏性皮疹，口唇肿胀，呼吸困难
C. 溶血性贫血，酱油尿、黑便
D. 胸闷、气短，心率加快，血压升高
E. 急性肾功能损害，尿量较少

正确答案：D。胸闷、气短，心率加快，血压升高

解析：本题考查蜈蚣的不良反应。不属于蜈蚣的不良反应的是胸闷气短，心率加快，血压升高（D错，为本题正确答案）。蜈蚣 不良反应表现： ①消化道症状：恶心、呕吐，腹痛、腹泻，十二指肠溃疡，黄疸、急性肝损害（A对）等。②循环系统：胸闷、气短，心律失常，血压下降等。③泌尿系统：急性肾功能损害，尿量减少（E对）等。④血液系统：溶血性贫血，酱油尿（C对）、黑便等。⑤神经系统：抽搐、面神经损害等。⑥过敏反应：过敏性皮疹、口唇肿胀、鼻黏性分泌物大量流出、呼吸困难（B对）等，严重者可致过敏性休克。